肉毒梭菌或肉毒毒素侵入人体的途径不包括
A. 医源性感染
B. 经被污染的空气吸入
C. 经伤口入侵
D. 节肢动物叮咬
E. 污染的食物

正确答案：D。节肢动物叮咬

解析：肉毒梭菌或肉毒毒素侵入人体的途径包括因进食含肉毒毒素或肉毒梭菌芽胞污染的食物（E对）、创伤（C对）、医源性（A对）或吸入性肉毒中毒等，故经被污染的空气吸入不属于肉毒梭菌或肉毒毒素侵入人体的途径（B对，排除法D为本题的正确答案）。